正常人每日释放的甲状腺激素中，甲状腺素占
A. 5～10μg
B. 15～30μg
C. 40～50μg
D. 50～60μg
E. 70～90μg

正确答案：E。70～90μg

解析：甲状腺激素是维持机体正常代谢、促进生长发育所必需的激素，包括甲状腺素和三碘甲状腺原氨酸，正常人每日释放量分别为70～90μg及15～30μg。掌握“硫脲类药物”知识点。